喷射性呕吐，可见于
A. 耳源性眩晕
B. 胃炎
C. 肠梗阻
D. 尿毒症
E. 脑炎

正确答案：E。脑炎

解析：喷射性呕吐常发生在患有脑部疾病时，如脑炎（E对）或脑部肿瘤，因颅内压增高而出现喷射性呕吐。耳源性眩晕（A错）、胃炎（B错）、肠梗阻（C错）、尿毒症（D错）表现为非喷射性呕吐。